按手术期限，下列属于限期手术的是
A. 慢性阑尾炎切除术
B. 直肠癌根治术
C. 完全性肠梗阻造瘘术
D. 可复性股疝修补术
E. 急性上消化道穿孔修补术

正确答案：B。直肠癌根治术

解析：按手术期限，属于限期手术的是直肠癌根治术（B对）。慢性阑尾炎切除术（A错）、可复性股疝修补术（D错）属于择期手术。完全性肠梗阻造瘘术（C错）、急性上消化道穿孔修补术（E错）属于急症手术。